艾滋病的英文缩写是
A. ARDS
B. AIDS
C. HIV
D. HBV
E. HAV

正确答案：B。AIDS